其对映异构体产生不同类型药理活性的药物是
A. 丙氧酚
B. 依托唑啉
C. 异丙嗪
D. L-甲基多巴
E. 氯苯那敏

正确答案：A。丙氧酚

解析：本题考查药物的手性特征及其对药物作用的影响。丙氧酚（A对）的对映异构体之间产生不同类型的药理活性。右丙氧酚是镇痛药，其对映异构体左丙氧酚是镇咳药。依托唑啉（B错）的对映异构体活性相反。利尿药依托唑啉的左旋体具有利尿作用，右旋体则有抗利尿作用，因为这类药物的对映体与受体均有一定的亲和力，但通常只有一种对映体具有活性，另一对映体反而起拮抗剂的作用。异丙嗪（C错）的对映异构体之间活性强度相同，均为抗组胺药。抗高血压药物L-甲基多巴（D错）仅L-构型的化合物有效，其对映异构体无活性，产生这种构型与活性差异的原因部分是来自受体对药物的空间结构要求比较严格。氯苯那敏（E错）的对映异构体产生相同的药理活性，但强弱不同。氯苯那敏的右旋体的活性高于左旋体，产生的原因是由于分子中的手性碳原子离芳环近，对药物受体相互作用产生空间选择性。